男，7岁，突发寒战，髙热，右膝下方剧痛3天，查体T39.8℃，P86次/分，R25次/分，BP110/60mmHg。烦躁不安，右膝关节呈半屈曲状，拒动，右小腿近端皮温高，肿胀不明显，压痛阳性。最可能的诊断是
A. 风湿性关节炎
B. 急性血源性骨髄炎
C. 膝关节结垓
D. 类风湿关节炎
E. 化脓性关节炎

正确答案：B。急性血源性骨髄炎

解析：儿童患者，起病急，突发寒战，髙热至T39.8℃；右膝下方剧痛3天，查体：烦躁不安，右膝关节呈半屈曲状，拒动，右小腿近端皮温高，压痛阳性。综合该患者的病史、体查，该患者诊断考虑为急性血源性骨髄炎（B对）；风湿性关节炎（九版内科学P805）（A错）发病前1-6周常有上呼吸道感染症状，呈游走性，多发性关节炎。膝关节结核（P759）（C错）起病缓慢，有低热、乏力、疲倦、食欲差、消瘦、贫血等全身症状。膝眼饱满，髌上囊肿大，浮髌试验阳性。儿童类风湿关节炎（P740）（D错）发热常与一过性斑丘疹和多形红斑同时发生和消退，且肝、脾、淋巴结多肿大；化脓性关节炎（P746）（E错）时关节腔内积液明显，可见髌上囊明显隆起，浮髌试验可为阳性。